以下有关“传统模式”的医患关系的描述正确的是
A. 医生作出决定，病人听命于医生，服从医生的判断与决策
B. 与疾病相比，更重视病人本身
C. 病人身体和心理不能分割，两者均是医生考虑的重点
D. 对病人的帮助不仅靠技术措施，还应充当教育、引导和促进的作用
E. 以上都不正确

正确答案：A。医生作出决定，病人听命于医生，服从医生的判断与决策

解析：传统模式这种模式是从传统的生物医学模式中派生出来的。在医疗活动中医生所关心的只是疾病的处理、科学知识的解释以及标准技术和常规技能的应用，很少考虑病人的期望和感受。医生对病人保持情感上的“立”，而病人则被动地服从医生的判断与决策。掌握“医患沟通的理论、技术与其应用以及医患关系模式”知识点。